患者，男，45岁。神思恍惚，梦魂颠倒，心悸易惊，善悲欲哭，肢体困乏，饮食减少，舌质淡，脉细无力。其治法是
A. 健脾养心，益气活血
B. 健脾养心，化痰解郁
C. 益气养血，化浊祛痰
D. 健脾养心，益气安神
E. 益气和胃，养心安神

正确答案：D。健脾养心，益气安神

解析：患者以神思恍惚为主诉，故诊断为癫狂。癫病日久，心血内亏，心神失养，故神思恍惚，梦魂颠倒，心悸易惊，善悲欲哭；血少气衰，脾失健运，故肢体困乏，饮食减少；舌质淡，脉细无力，均为心脾两亏，气血俱衰，故其证候为心脾两虚证，治以健脾养心，益气安神（D对）。健脾养心，益气活血和健脾养心，化痰解郁，表述相似，需参考教材（AB错)。本病例没有“咽喉痰鸣，舌淡胖，舌苔白腻”等痰浊内蕴的证候（C错）。本病例无“恶心、呕吐、吐酸”等胃经病症（E错）。